膜剂的制备工艺流程为
A. 药材浸提→纯化→浓缩→分装→灭菌
B. 溶浆→加药及辅料→脱泡→制膜→干燥→脱膜→分剂量→包装
C. 药材煎煮→浓缩（炼糖）→收膏→分装
D. 溶解成膜材料→加药及增塑剂→混合→分剂量→包装
E. 药材浸提→纯化→浓缩（单糖浆）→浓缩药液→混合→滤过→分装→灭菌

正确答案：B。溶浆→加药及辅料→脱泡→制膜→干燥→脱膜→分剂量→包装

解析：本题考查膜剂的制备工艺流程。膜剂的制备工艺流程为溶浆→加药及辅料→脱泡→制膜→干燥→脱膜→分剂量→包装（B对）。膜剂工艺流程：成膜材料→溶浆→（药物）加药匀浆→涂膜→干燥灭菌→分剂量→包装→成品。合计制备工艺：饮片→浸提→精制→浓缩→（矫味剂、防腐剂等辅料）配液→滤过→分装→灭菌→成品（A错）。煎膏剂工艺流程：饮片→煎煮→浓缩→蔗糖或蜂蜜（炼制加入）→收膏→分装→成品（C错）。涂膜剂工艺流程：溶解成膜材料→加药及增塑剂→混合→分剂量→包装（D错）。糖浆剂制备工艺：饮片→浸提→精制→浓缩→（蔗糖或单糖浆、防腐剂等辅料）配液→滤过→分装→成品（E错）。